下列关于职业病论述错误的是
A. 职业性有害因素作用于人体的强度和时间超过一定限度引起的疾病
B. 职业性有害因素引起人体不能代偿的功能和器质性损害出现的疾病
C. 职业性有害因素引起健康损害，并出现相应的临床征象，影响劳动力
D. 政府规定，职业病均享有劳保待遇
E. 职业性有害因素直接引起的疾病均称为职业病

正确答案：D。政府规定，职业病均享有劳保待遇